阑尾炎手术时寻找阑尾最可靠的方法是
A. 沿结肠旁沟寻找
B. 打开网膜囊找
C. 沿小肠系膜寻找
D. 沿回肠动脉寻找
E. 沿结肠带向盲肠端寻找

正确答案：E。沿结肠带向盲肠端寻找

解析：有三条结肠带会聚于阑尾根部，其中独立带更明显，沿该结肠带向盲肠寻找(E对)最可靠。